血白细胞增多，可见于
A. 伤寒杆菌感染
B. 再生障碍性贫血
C. 急性失血
D. 脾功能亢进
E. 以上均非

正确答案：C。急性失血

解析：白细胞总数增多或减少主要受中性粒细胞数量的影响。引起中性粒细胞增多的原因有：①急性感染；②严重的组织损伤及大量血细胞破坏；③急性大出血（C对E错）：在急性大出血后1～2小时内，周围血中的血红蛋白含量及红细胞数尚未下降，而白细胞数及中性粒细胞却明显增多，特别是内出血时，白细胞可高达20✕l0⁹/L；④急性中毒。伤寒杆菌感染（A错）可出现特殊中毒面容，相对缓脉，皮肤玫瑰疹，肝脾肿大，周围血象白细胞总数低下，嗜酸性粒细胞消失，骨髓象中有伤寒细胞。再生障碍性贫血（B错）为骨髓造血功能障碍性疾病，血中白细胞减少。脾功能亢进（D错）时，血细胞减少，但细胞形态正常，早期以白细胞及血小板减少为主，重度脾亢时可出现三系明显减少。骨髓检查呈增生象，可出现成熟障碍，这是因为外周血细胞大量破坏，促使细胞过度释放所致。